体内CO₂分压最高的部位是
A. 静脉血液
B. 毛细血管血液
C. 动脉血液
D. 组织液
E. 细胞内液

正确答案：E。细胞内液

解析：人体中血液的流动过程为：心脏→动脉→毛细血管→组织细胞→静脉→心脏，随着血液的流动和组织的耗氧可得出体内CO₂分压由高到低排序为：细胞内液（CO₂由此处产生）（E对）＞组织液（D错）＞毛细血管血液（B错）＞静脉血液（A错）＞肺动脉（C错）内的混合静脉血＞肺泡气＞呼出气＞大气。